下述哪项是对病例对照研究的描述
A. 对既往死亡或发病进行研究，以便能够对将来疾病的发生作出估计
B. 根据所积累的某病与某因素有关的假设，对不同地区和不同情况下进行的既往研究作分析
C. 为确立病例中调研因素的特征的相对频率，获得病例组和对照组的病史及其他信息
D. 在已戒烟的男性组和尚在吸烟的对照组中研究癌症的相对危险度
E. 不同层次人群中调查的疾病的流行率

正确答案：C。为确立病例中调研因素的特征的相对频率，获得病例组和对照组的病史及其他信息